评价筛检真实性的指标是
A. 治愈率
B. 生存率
C. 约登指数
D. 死亡率
E. 阳性预测值

正确答案：C。约登指数

解析：本题考查筛检评价真实性的指标。评价真实性的指标有灵敏度与假阴性率、特异度与假阳性率、正确指数和似然比。正确指数也称约登指数（C对ABDE错），是灵敏度与特异度之和减去1，表示筛检方法识别真正病人与非病人的总能力。正确指数的范围在0～1之间。指数越大，真实性越高。